由股四头肌腱的中央部纤维索，自髌骨向下止于胫骨粗隆的是
A. 前交叉韧带
B. 内、外侧半月板
C. 髌韧带
D. 后交叉韧带
E. 胫侧副韧带

正确答案：C。髌韧带

解析：髌韧带（C对）是由股四头肌腱的中央部纤维索，自髌骨向下止于胫骨粗隆。